胆囊切除手术中，不适合胆总管探查指征的是
A. 胆总管有扩张
B. 曾有梗阻性黄疸史
C. 胆囊水肿
D. 术中胆管造影示胆管结石
E. 胆总管触到结石

正确答案：C。胆囊水肿

解析：急性胆囊炎几乎均有胆囊充血水肿，胆囊水肿并不是行胆总管探查术的指征（C错，为本题正确答案）。胆总管有扩张（A对）、曾有梗阻性黄疸史（B对）、术中胆管造影示胆管结石（D对）、胆总管触到结石（E对）均属于胆总管探查指征。